收缩鼻腔黏膜血管，减轻鼻充血
A. 右美沙芬
B. 奥司他韦
C. 金刚乙胺
D. 氯苯那敏
E. 伪麻黄碱

正确答案：E。伪麻黄碱

解析：本题考查氯苯那敏。收缩鼻腔黏膜血管，减轻鼻充血的是伪麻黄碱（E对）。伪麻黄碱为α受体激动剂，可对鼻甲中的血管产生收缩作用，通过减少鼻黏膜中的血流而缓解鼻塞症状。右美沙芬（A错）为中枢性镇咳药。奥司他韦（B错）、金刚乙胺（C错）为抗病毒药。氯苯那敏（D错）对打喷嚏、流鼻涕为主的患者，有一定镇静作用。